噻嗪类利尿药不良反应
A. 代谢变化
B. 过敏反应
C. 高尿酸血症
D. 电解质紊乱
E. 以上说法均正确

正确答案：E。以上说法均正确

解析：噻嗪类利尿药不良反应：①电解质紊乱：如低血钾、低血钠、低血镁、低氯性碱血症等，合用留钾利尿药可防治。②高尿酸血症：痛风者慎用。③代谢变化：可导致高血糖、高脂血症。可能是因其抑制了胰岛素的分泌以及减少组织利用葡萄糖。可使血清胆固醇增加5%～15%，并增加低密度脂蛋白。④过敏反应：与磺胺类有交叉过敏反应。可见皮疹、皮炎（包括光敏性皮炎）等，偶见严重的过敏反应。掌握“袢利尿药及噻嗪类”知识点。